关于《加强中药饮片流通监督管理办法的通知》中，说法错误的是
A. 生产中药饮片，必须取得《药品生产许可证》和《GMP》
B. 生产中药饮片必须使用符合药品标准的药材，并且原药材尽量使用固定产地的
C. 生产中药饮片必须按照国家药品炮制标准或者地方炮制规范
D. 生产中药饮片必须有严格要求的场所分包装
E. 零售中药饮片必须取得《药品经营许可证》和《GSP》

正确答案：D。生产中药饮片必须有严格要求的场所分包装

解析：本题考查中药饮片流通监督管理。关于《加强中药饮片流通监督管理办法的通知》中，说法错误的是生产中药饮片必须有严格要求的场所分包装（D错，为本题正确答案）。生产中药饮片必须持有《药品生产许可证》、《药品GMP证书》（A对）；必须以中药材为起始原料，使用符合药用标准的中药材，并应尽量固定药材产地（B对）；必须严格执行国家药品标准和地方中药饮片炮制规范、工艺规程（C对）；必须在符合药品GMP条件下组织生产，出厂的中药饮片应检验合格，并随货附纸质或电子版的检验报告书。批发零售中药饮片必须持有《药品经营许可证》、《药品GSP证书》（E对），必须从持有《药品GMP证书》的生产企业或持有《药品GSP证书》的经营企业采购。